患者，男，56岁。有高血压病史4年。体检：血压156/96mmHg，无主动脉狭窄。医师处方依那普利片控制血压。该患者若长期服用依那普利片，除应监测血压、心、肾功能外，还应监测的指标是
A. 血钾
B. 血钠
C. 血钙
D. 血氯
E. 血镁

正确答案：A。血钾

解析：本题考查依那普利的使用。依那普利是血管紧张素转换酶抑制剂（ACEI），长期使用可能导致血钾升高，应定期监测血钾（A对）的水平，以免发生高钾血症。